患者饱餐后上腹部持续疼痛1天。查体：上腹部压痛、反跳痛。应首先考虑的是
A. 急性胃炎
B. 急性胰腺炎
C. 急性肝炎
D. 右肾结石
E. 肝癌

正确答案：B。急性胰腺炎

解析：患者饱餐后上腹部持续疼痛1天。查体：上腹部压痛、反跳痛。首先考虑诊断为急性胰腺炎（B对）。急性胃炎（A错）无反跳痛。急性肝炎（C错）、肝癌（E错）引起的疼痛为肝区的压痛及叩痛。右肾结石（D错）为腹部绞痛，无反跳痛。